膜性肾病光镜下的表现是
A. 可见肾小球系膜细胞和系膜基质弥漫增生
B. 可见病变呈局灶、节段分布
C. 肾小球基底膜增厚
D. 肾小球正常
E. 系膜细胞和系膜基质弥漫重度增生

正确答案：C。肾小球基底膜增厚

解析：膜性肾病光镜下可见肾小球弥漫性病变，早期仅于肾小球基底膜上皮侧见少量散在分布的嗜复红小颗粒（Masson染色）；进而有钉突形成（嗜银染色），基底膜逐渐增厚（C对）。